三期梅毒的主要表现是
A. 硬下疳
B. 横痃
C. 杨梅疮
D. 杨梅结节
E. 尿道口溢脓

正确答案：D。杨梅结节

解析：三期梅毒的主要表现是杨梅结节（D对），即结节性梅毒疹。杨梅疮（C错）即梅毒疹二期梅毒的主要表现是。硬下疳（A错）是一期梅毒的主要表现。横痃（B错）即腹股沟淋巴结肿大，见于多种性传播疾病，亦可见于二期梅毒。尿道口溢脓（E错）主要见于淋病。